男，38岁。会阴部骑跨伤，受伤后尿道外口滴血，会阴部和阴囊处肿胀、瘀斑及蝶形血肿。该患者泌尿系损伤的部位是
A. 尿道阴茎部
B. 尿道球部
C. 膀胱
D. 尿道前列腺部
E. 尿道膜部

正确答案：B。尿道球部

解析：青年男性患者，会阴部骑跨伤（提示可能有前尿道损伤）后，尿道外口滴血，会阴部和阴囊处肿胀、瘀斑及蝶形血肿（前尿道损伤典型表现），结合患者病史和临床表现，该患者泌尿系损伤的部位是前尿道，最多见于尿道球部（B对）。尿道阴茎部（A错）损伤较少见，多由弹片、锐器所致，开放性损伤多见。膀胱（C错）损伤多见于贯通伤或骨盆骨折，主要表现为剧烈腹痛、大出血致休克、腹膜刺激症等，不会出现会阴部和阴囊的肿胀等表现。尿道前列腺部（D错）和尿道膜部（E错）损伤均属于后尿道损伤，一般不会出现会阴部和阴囊的肿胀等表现。